某印染厂男工，45岁，工龄约10年。某日下班后突感到头痛、头晕、口唇及指端发绀，送急诊室就诊。口唇与指甲出现紫绀的主要原因是
A. 麻醉作用引起的呼吸抑制
B. 肺氧分压下降引起的血氧分压下降
C. 形成碳氧血红蛋白
D. 抑制了细胞内呼吸
E. 形成高铁血红蛋白

正确答案：E。形成高铁血红蛋白

解析：本题考查苯胺中毒引起的症状。从事印染行业的工人，处于长期暴露于苯胺的状态。同时长期慢性接触苯胺可出现类神经症，如头晕、头痛等症状，并出现口唇、指端及耳垂等部位的化学性发绀症状，该工人的表现符合苯胺中毒的症状，为苯胺中毒。口唇、指端和耳垂等部位的发绀是因为苯胺的中间代谢产物苯胲有很强的形成高铁血红蛋白（E对ABCD错）的能力，使血红蛋白失去携氧功能而导致的。